牙周膜的血液供应来自
A. 牙槽动脉
B. 上唇动脉
C. 下唇动脉
D. 面横动脉
E. 眶下动脉

正确答案：A。牙槽动脉

解析：本题考查牙周膜。牙周膜含有丰富的血管，来自牙槽动脉（A对）的分支。